评价学校口腔健康教育后学生有关口腔保健知识转变时可使用的指标是
A. 形成率
B. 检出率
C. 知晓率
D. 正确应答率
E. 因病缺课率

正确答案：C。知晓率